属于正常细胞性贫血的是
A. 急性失血性贫血
B. 巨幼细胞性贫血
C. 缺铁性贫血
D. 慢性失血性贫血
E. 铁粒幼细胞性贫血

正确答案：A。急性失血性贫血

解析：急性失血性贫血，表现为红细胞短时间内丢失过多，红细胞形态未有变化。掌握“贫血概论及缺铁性贫血”知识点。